1周岁后到满3周岁之前，属于
A. 婴儿期
B. 学龄前期
C. 围产期
D. 幼儿期
E. 新生儿期

正确答案：D。幼儿期

解析：幼儿期：1周岁后到满3周岁之前。掌握“小儿年龄分期”知识点。